下列粉尘的理化特性何者致纤维化作用意义最大
A. 粉尘的化学成分和粉尘浓度
B. 粉尘的硬度
C. 粉尘的溶解度
D. 粉尘的荷电性
E. 粉尘的爆炸性

正确答案：A。粉尘的化学成分和粉尘浓度

解析：本题考查粉尘的致纤维化能力。肺尘埃沉着病（俗称尘肺）是由于在生产环境中长期吸入生产性粉尘而引起的以肺组织纤维化为主的疾病。粉尘致纤维化能力强弱取决于粉尘中二氧化硅的含量（A对BCDE错），石英中二氧化硅含量最高，达到99%。因此，石英尘在同样浓度和分散度下，它的致纤维化能力最强。